内科医生王某，在春节回家探亲的火车上遇到一位产妇临产，因火车上无其他医务人员，王某遂协助产妇分娩，在分娩过程中，因牵拉过度，导致新生儿左上肢臂丛神经损伤。王某行为的性质
A. 属于违规操作，构成医疗事故
B. 属于非法行医，不属于医疗事故
C. 属于超范围执业，构成医疗事故
D. 属于见义勇为，不构成医疗事故
E. 虽造成不良后果，但不属于医疗事故

正确答案：E。虽造成不良后果，但不属于医疗事故

解析：医疗事务的无因管理，是指医师在没有约定义务和法定义务情况下，为避免患者的生命健康利益受到损害，自愿为患者提供医疗服务的行为。医疗事务无因管理关系，主要是基于以下三种情形：一是医师在医院外发现昏迷之患者而加以治疗；二是对自杀未遂而不愿就医者，予以救治；三是特定的第三人将意识不明或不能作意思表示的患者送到医院抢救的。掌握“医疗事故的技术鉴定”知识点。